关于筛检的目的，下列说法不正确的一项是
A. 发现高度可疑患病的人群
B. 使患者和非患者明确分开
C. 发现高危人群
D. 了解疾病的自然史
E. 指导合理分配有限的卫生资源

正确答案：B。使患者和非患者明确分开

解析：本题考查的是筛检的目的。筛检的目的包括：1.发现隐匿病例（A对）；2.发现高危人群（C对）；3.了解疾病的自然史（D对），揭示疾病的“冰山现象”；4.指导合理分配有限的卫生资源（E对）。使患者和非患者明确分开（B错，为本题正确答案）不属于筛检的目的。